卡托普利主要通过哪项而产生降压作用
A. 利尿降压
B. 血管扩张
C. 钙拮抗
D. ANG转换酶抑制
E. α受体阻断

正确答案：D。ANG转换酶抑制

解析：本题考查卡托普利。卡托普利主要通过ANG转换酶抑制（D对）而产生降压作用。卡托普利等ACEI制剂可以抑制血管紧张素转化酶的活性，抑制血管紧张素Ⅰ转换成血管紧张素Ⅱ。利尿降压（A错）是利尿剂的作用。血管扩张（B错）是血管扩张药如硝酸酯类的作用机制。钙拮抗（C错）是钙拮抗剂的作用。阻断α受体（E错）是α受体阻断剂的作用。